患儿，10个月。高热烦躁，气急鼻煽，张口抬肩，喉中痰鸣，声如拽锯，口唇紫绀。其治法是
A. 清热宣肺，涤痰定喘
B. 清热解毒，止咳化痰
C. 辛凉开肺，清热化痰
D. 清热活血，泻肺化痰
E. 泻肺镇咳，清热化痰

正确答案：A。清热宣肺，涤痰定喘

解析：根据患儿高热，气急鼻煽，张口抬肩，喉中痰鸣，声如拽锯，可辨证为痰热壅肺证--痰热壅肺，火热上炎，气动痰升，故高热，喉中痰鸣，声如拽锯；肺络阻塞，清肃失职，故张口抬肩，气急鼻煽；痰热扰心，故烦躁；热毒壅盛，气滞血瘀，血流不畅，故口唇紫绀。因此，当治以清热宣肺，涤痰定喘（A对），宜选五虎汤合葶苈大枣泻肺汤。